幻觉的定义是
A. 对客观事物的错误感受
B. 对客观事物的歪曲
C. 缺乏相应的客观刺激时的感知体验
D. 客观刺激作用于感觉器官的感知体验
E. 缺乏客观刺激时的思维过程

正确答案：C。缺乏相应的客观刺激时的感知体验

解析：幻觉是指没有现实刺激作用于感觉器官时出现的知觉体验（C对），是一种虚幻的知觉。对客观事物的错误感受和歪曲为错觉（AB错）。客观刺激作用于感觉器官的感知体验为感觉（D错）。